对于婴幼儿的年龄是否标注为日龄、月龄的审核属于
A. 规范性审核
B. 适宜性审核
C. 合法性审核
D. 经济性审核

正确答案：A。规范性审核

解析：本题考查处方审核。处方审核包括合法性审核、规范性审核、适宜性审核。处方规范性审核（A对）包括：①处方是否符合规定的标准和格式，处方医师签名或加盖的专用签章有无备案，电子处方是否有处方医师的电子签名；②处方前记、正文和后记是否符合《处方管理办法》等有关规定，文字是否正确、清晰、完整；③条目是否规范：年龄应当为实足年龄，新生儿、婴幼儿应当写日、月龄，必要时要注明体重。其中适宜性审核（B错）中，西药及中成药处方应当审核以下项目：处方用药与诊断是否相符；规定必须做皮试的药品，是否注明过敏试验及结果的判定；处方剂量、用法是否正确，单次处方总量是否符合规定；选用剂型与给药途径是否适宜。其中合法性审核（C错）包括：①处方开具人是否根据《执业医师法》取得医师资格，并执业注册；②处方开具时，处方医师是否根据《处方管理办法》在执业地点取得处方权；③麻醉药品、第一类精神药品、医疗用毒性药品、放射性药品、抗菌药物等药品处方，是否由具有相应处方权的医师开具。